白花蛇的功效是
A. 祛风，解表，止痛
B. 祛风，通络，利尿
C. 祛风，活络，定惊
D. 祛风湿，强筋骨
E. 祛风湿，治骨鲠

正确答案：C。祛风，活络，定惊

解析：蕲蛇又称白花蛇，功效是祛风，通络，止痉（C对）。独活的功效是祛风，解表，止痛（A错）。青风藤的功效是祛风，通络，利尿（B错）。杜仲的功效是祛风湿，强筋骨（D错），安胎。威灵仙的功效是祛风湿，治骨鲠（E错），通络止痛。